空气和表面消毒方法
A. 干热灭菌法
B. 紫外灭菌法
C. 热压灭菌法
D. 煮沸灭菌法
E. 流通灭菌法

正确答案：B。紫外灭菌法

解析：本题考查灭菌方法。空气和表面消毒方法紫外灭菌法（B对）。紫外线灭菌法：是指用紫外线照射杀灭微生物的方法。本法适用于物品表面的灭菌、无菌室空气及蒸馏水的灭菌；不适用于药液和固体物质深部的灭菌；普通玻璃容器可吸收紫外线，因此装于其中的药物不能用此法灭菌。凡士林的消毒方法干热灭菌法（A错）。干热灭菌法：是指在干热环境中灭菌的方法，包括火焰灭菌法和干热空气灭菌法。此法适用于耐高温但不宜用湿热灭菌法灭菌的物品灭菌，如玻璃器具、金属制容器、纤维制品、固体试药、液状石蜡等均可采用本法灭菌。大输液消毒方法热压灭菌法（C错）。热压灭菌法：是采用高压饱和水蒸气加热杀灭微生物的方法。此法具有很强的灭菌效果，灭菌可靠，能杀灭所有细菌繁殖体和芽胞，是在制剂生产中应用最广泛的一种灭菌方法。凡能耐高压蒸汽的药物制剂、玻璃容器、金属容器、瓷器、橡胶塞、膜过滤器等均能采用此法。煮沸灭菌法（D错）是把待灭菌物品放人沸水中加热灭菌的方法。通常煮沸30～60min。此法灭菌效果差，常用于注射器、注射针等器皿的消毒。必要时加入适当的抑菌剂，如甲酚、氯甲酚、苯酚、三氯叔丁醇等，以提高灭菌效果。流通蒸汽灭菌法（E错）：是在常压下使用100℃流通蒸汽加热杀灭微生物的方法。通常灭菌时间为30～60min。此法适用于消毒及不耐高热的制剂的灭菌，但不能保证杀灭所有的芽胞，系非可靠的灭菌法，一般可作为不耐热无菌产品的辅助灭菌手段。